下列药物具有抗病毒作用的是
A. 转移因子
B. 类固醇激素
C. 阿糖腺苷
D. 泰而登
E. 阿司匹林

正确答案：C。阿糖腺苷

解析：本题考查抗病毒药。下列药物具有抗病毒作用的是转移因子（A对）、阿糖腺苷（C对）。类固醇激素（B错）可影响机体物质代谢，具有强大的抗炎作用、免疫抑制与抗过敏作用、抗休克作用等，可用于严重感染或炎症、免疫相关疾病、抗休克治疗等。泰而登（D错）硫杂蒽类抗精神分裂药，适用于带有强迫状态或焦虑抑郁情绪的精神分裂症、焦虑性神经官能症以及迓年期抑郁症患者。阿司匹林（E错）具有解热镇痛及抗风湿、影响血小板聚集及抗血栓形成，可用于止疼、缓解风湿性关节炎的症状，缺血性心脏病、脑缺血病、房颤或其他术后防止血栓形成。